痣细胞在表皮和真皮交界处，呈多个巢团状，每一巢团的上一半在表皮的底层内，下一半则在真皮浅层内，称为
A. 雀斑样色素痣
B. 复合痣
C. 皮内痣
D. 毛痣
E. 交界痣

正确答案：E。交界痣

解析：交界痣：痣细胞在表皮和真皮交界处，呈多个巢团状，边界清楚，分布距离均匀；每一巢团的上一半在表皮的底层内，下一半则在真皮浅层内。这些痣细胞为大痣细胞，色素较深。掌握“色素痣”知识点。